阴寒之邪壅盛于内，逼迫阳气浮越于外的病机是
A. 阴盛格阳
B. 阴损及阳
C. 阳损及阴
D. 阳盛格阴
E. 以上均非

正确答案：A。阴盛格阳

解析：阴盛格阳，指阳气极虚，导致阴寒之气偏盛，壅闭于里，逼迫阳气浮越于外，而出现内真寒外假热的病机变化（A对）；阴损及阳，指由于阴气亏损，累及阳气生化不足，或阳气无所依附而耗散，从而在阴虚的基础上又出现阳虚，形成以阴虚为主的阴阳两虚的病机变化（B错）；阳损及阴，指由于阳气虚损，无阳则阴无以生，从而在阳虚的基础上又导致阴虚，形成以阳虚为主的阴阳两虚的病机变化（C错）；阳盛格阴，指阳气偏盛至极，壅遏于内，排斥阴气于外，而出现内真热外假寒的病机变化（D错）。